鼻面沟与唇面沟合称为
A. 鼻面沟
B. 唇面沟
C. 颏唇沟
D. 鼻唇沟
E. 鼻小柱

正确答案：D。鼻唇沟

解析：鼻面沟与唇面沟合称为鼻唇沟。掌握“面部表面解剖”知识点。